大血藤的断面特征为
A. 皮部白色，有红棕色油点
B. 韧皮部与木部相间排列
C. 皮部红棕色，有数处向内嵌入木部
D. 髓部偏向一侧
E. 形成层环呈多角形

正确答案：C。皮部红棕色，有数处向内嵌入木部

解析：本题考查的是大血藤药材的性状鉴别。大血藤的断面特征为皮部红棕色，有数处向内嵌入木部（C对）。大血藤：【性状鉴别】药材呈圆柱形，略弯曲。表面灰棕色，粗糙，外皮常呈鳞片状剥落，剥落处显暗红棕色，有的可见膨大的节及略凹陷的枝痕或叶痕。质硬，断面皮部红棕色，有数处向内嵌入木部，木部黄白色，有多数细孔状导管，射线呈放射状排列。气微，味微涩。韧皮部与木部相间排列（B错）与髓部偏向一侧（D错）为鸡血藤药材断面的特征。鸡血藤：【性状鉴别】药材呈椭圆形、长矩圆形或不规则的斜切片。栓皮灰棕色，有的可见灰白色斑块，栓皮脱落处显红棕色。质坚硬。切面木部红棕色或棕色，导管孔多数；韧皮部有树脂状分泌物呈红棕色至黑棕色，与木部相间排列呈数个同心性椭圆形环或偏心性半圆形环；髓部偏向一侧。气微，味涩。形成层环呈多角形（E错）为川乌药材断面的特征。川乌：【性状鉴别】药材呈不规则圆锥形，稍弯曲，顶端常有残茎，中部多向一侧膨大。表面棕褐色或灰棕色，皱缩，有小瘤状侧根及子根脱离后的痕迹。质坚实。断面类白色或浅灰黄色，形成层环纹呈多角形。气微，味辛辣、麻舌。皮部白色，有红棕色油点（A错）的药材，2022年考试指南未明确说明。